下列措施中不属于二级预防的是
A. 乳腺癌筛查
B. 在高危人群中定期检测HIV
C. 学生、新兵体检
D. 筛查高血压，预防脑卒中
E. 通过粪隐血试验筛检结直肠癌

正确答案：D。筛查高血压，预防脑卒中